膀胱肿瘤早期症状主要表现为
A. 镜下血尿
B. 终末血尿
C. 间歇性无痛性肉眼血尿终末加重
D. 腰痛伴血尿
E. 血尿伴膀胱刺激症状

正确答案：C。间歇性无痛性肉眼血尿终末加重